粒细胞缺乏症的诊断标准是指外周血的粒细胞绝对数低于
A. 0.2×10⁹
B. 0.5×10⁹
C. 4.0×10⁹
D. 1.5×10⁹
E. 3.0×10⁹

正确答案：B。0.5×10⁹

解析：粒细胞缺乏症的诊断标准是指外周血的粒细胞绝对值低于0.5×10⁹/L（B对）。外周血的中性粒细胞绝对值低于1.5×10⁹/L是10岁以下儿童中性粒细胞减少症的标准（D错）。